评价筛检收益的主要指标是
A. 灵敏度
B. 特异度
C. 正确指数
D. 预测值
E. 阳性预测值

正确答案：E。阳性预测值